氰化物中毒，选用的解毒剂是
A. 二巯丁二钠
B. 亚甲蓝
C. 氯解磷定
D. 氟马西尼
E. 盐酸纳洛酮

正确答案：B。亚甲蓝

解析：本题考查氰化物中毒解救。氰化物中毒，选用的解毒剂是亚甲蓝（B对）。氰化物中毒的解毒剂有亚硝酸异戊酯、亚硝酸钠、亚甲蓝和硫代硫酸钠。二巯丁二钠（A错）用于锑、铅、汞、砷的中毒，并预防镐、钴、镍的中毒。氯解磷定（C错）用于有机磷中毒的解救。氟马西尼（D错）用于治疗苯二氮䓬类药物中毒。盐酸纳洛酮（E错）主要用于阿片类药物中毒的解救。